属抗代谢类抗癌药物是
A. 氮芥
B. 平阳霉素
C. 甲氨蝶呤
D. 长春新碱
E. 顺铂

正确答案：C。甲氨蝶呤

解析：甲氨蝶呤属于抗代谢类抗癌药物。掌握“口腔颌面部肿瘤的治疗原则及预防”知识点。